最易导致肺气肿、肺心病的肺结核是
A. 原发型肺结核
B. 血行播散型肺结核
C. 浸润型肺结核
D. 慢性纤维空洞型肺结核
E. 结核性胸膜炎

正确答案：D。慢性纤维空洞型肺结核